人体试验中的医学目的原则中不包括
A. 为了提高医疗水平，改进诊治和预防措施
B. 为了对疾病病因学的发病机理的了解
C. 为了更好地维护人类的健康服务
D. 为了获取更多的经济利益
E. 为了更好地增进人类的健康

正确答案：D。为了获取更多的经济利益

解析：为了获取更多的经济利益不是人体试验中的医学目的原则（D错，为本题正确答案）。人体试验的目标是以提高诊断、治疗和预防技术水平为目标（A对），以达到了解疾病的病因与发病机制（B对），从而更好地维护与增进人类健康（CE对），促进医学发展。